下列关于短效口服避孕药服用方法的叙述，正确的是
A. 月经来潮第1天起，每天1片，连服22天
B. 月经净后第1天起，每天1片，连服22天
C. 月经来潮第5天起，每晚1片，连服22天
D. 有房事时服1片
E. 月经来潮第5天服1片，20天后再服1片

正确答案：C。月经来潮第5天起，每晚1片，连服22天

解析：短效避孕药适用于长期同居的夫妇，有效率为99%以上，服用方法是在月经周期的第5天起每晚服1片，连服22天（C对）。妈富隆、复方孕二烯酮片、炔雌醇环丙孕酮片是从月经周期第1日开始按箭头所指方向，每晚服1片，连续21日服完，停药7日后，继服第2个周期。